气厥实证反复发作的原因，常是
A. 精神刺激
B. 头部外伤
C. 嗜食肥甘
D. 思虑过度
E. 先天禀赋

正确答案：A。精神刺激

解析：气厥实证，多发生于形体壮实者，遇精神刺激则肝气上逆，气血阴阳不相顺接，则恼怒致厥。（A对）。头部外伤、先天禀赋不是本病的病因(BE错）。嗜食肥甘常引起痰厥（C错）。思虑过度，可引起气厥虚证（D错）。